女，28岁。劳累后心悸、气短6年，加重伴咳粉红色泡沫痰1周。查体：心界扩大，心律绝对不齐，心尖部可闻及双期杂音。超声心动图示二尖瓣重度狭窄及中度关闭不全。该患者最恰当的治疗方案是
A. 先抗心衰治疗，择期行二尖瓣瓣膜修补术
B. 先抗心衰治疗，择期行二尖瓣置换术
C. 立即行二尖瓣球囊扩张术
D. 抗心衰治疗后口服药物治疗，随访
E. 立即行二尖瓣置换术

正确答案：B。先抗心衰治疗，择期行二尖瓣置换术

解析：患者青年女性，劳累后心悸、气短6年，加重伴咳粉红色泡沫痰1周（出现急性肺水肿）。查体见心界扩大，心律绝对不齐，心尖部可闻及双期杂音。超声心动图示二尖瓣重度狭窄及中度关闭不全。根据临床表现、体格检查、实验室检查可以诊断为二尖瓣狭窄及关闭不全。患者出现急性肺水肿，处理原则与急性左心衰竭所致的肺水肿一致，急性肺水肿时的缺氧与呼吸困难是致命的威胁必须尽快缓解（P289）（CE错）。对于中重度二尖瓣狭窄、呼吸困难进行性加重或有肺动脉高压发生者需通过机械性干预，解除二尖瓣狭窄。降低跨瓣压力阶差缓解症状。手术治疗是治疗二尖瓣狭窄和关闭不全的根本方法，方法有经皮球囊二尖瓣成形术、二尖瓣分离术、人工瓣膜置换术（B对A错）（P290）。治疗急性二尖瓣关闭不全，应在药物控制症状的基础上采取紧急或择期手术治疗。（D错）（P294）。